一氧化碳中毒导致机体缺氧是由于（）所致
A. 空气中氧含量过高
B. 组织利用氧能力障碍
C. 空气中氧含量过低
D. 血液运氧能力障碍
E. 血液氧分压过高

正确答案：D。血液运氧能力障碍

解析：本题考查CO主要的毒作用机制。急性CO中毒引起机体缺氧窒息最主要的机制是与Hb结合形成HbCO，经呼吸道吸入的CO，绝大部分与Hb分子中原卟啉Ⅸ的亚铁复合物发生紧密而可逆性结合，形成HbCO使Hb失去携氧能力（D对ABCE错），导致组织缺氧。